霍乱的典型临床表现是
A. 发热，腹痛，黏液脓血便，里急后重
B. 大量水样便，剧烈呕吐，无发热或明显腹痛
C. 发热，腹痛，果酱样便
D. 无发热，剧烈呕吐，少量黄水样便
E. 发热，剧烈腹痛，水样便或血便

正确答案：B。大量水样便，剧烈呕吐，无发热或明显腹痛

解析：霍乱的典型临床表现是霍乱肠毒素导致肠道痉挛，进而诱发肠道痉挛，出现大量水样便和剧烈呕吐，其中腹泻特点为无发热，无里急后重感，多数不伴腹痛，排便后自觉轻松感（B对）。